盐酸去氧肾上腺素的鉴别反应为
A. 火焰反应，火焰显紫色
B. 供试品的吡啶溶液加铜吡啶试液1滴，即显紫色
C. 供试品溶液加硝酸，即显红色，渐变为黄色
D. 制备衍生物测其熔点，应为174～178℃
E. 供试品溶液与三氯化铁试液作用，即显紫色

正确答案：E。供试品溶液与三氯化铁试液作用，即显紫色

解析：本题考查常用的药品鉴别方法。盐酸去氧肾上腺素的鉴别反应为供试品溶液与三氯化铁试液作用，即显紫色（E对）。含有一个酚羟基的去氧肾上腺素与三氯化铁试液反应显紫色，而具有邻二酚羟基结构的肾上腺素与三氯化铁试液反应则显翠绿色，颜色反应可用于两者的鉴别。火焰反应（A错）是元素的性质，钾元素焰色反应的颜色为紫色。供试品的吡啶溶液加铜吡啶试液1滴，即显紫色（B错）可用于鉴别巴比妥类药物；供试品溶液加硝酸，即显红色，渐变为黄色（C错）可用于鉴别盐酸氯丙嗪等吩噻嗪类药物；制备衍生物测其熔点，应为174～178℃（D错）不用于盐酸去氧肾上腺素的鉴别。